老年人服用糖皮质激素时，应注意的问题有
A. 易发生体位性低血压
B. 易发生消化道溃疡
C. 更年期妇女易发生骨质疏松症
D. 未能应用抗菌药物控制的细菌、真菌感染者禁用
E. 严重肝功能不全者不宜服用泼尼松龙

正确答案：B、C、D。易发生消化道溃疡；更年期妇女易发生骨质疏松症；未能应用抗菌药物控制的细菌、真菌感染者禁用

解析：本题考查糖皮质激素的使用。老年人长期使用糖皮质激素需要预防消化道溃疡（B对）、感染（D对）、骨质疏松症（C对）和高血压等；有精神病史的患者避免使用。糖皮质激素会导致高血压，而不会使老年人发生体位性低血压（A错）。泼尼松龙无需经肝脏转化可直接发挥效应，严重肝功能不全者也可使用（E错）。